下面哪项描述为带状疱疹的主要临床表现
A. 单侧性皮肤黏膜疱疹，沿神经支分布及剧烈的疼痛
B. 成簇小水疱，疱破后行成大片浅表溃疡
C. 散在小溃疡，无发疱期
D. 口腔黏膜突然发生广泛的糜烂
E. 口腔黏膜充血，局部形成糜烂或溃疡

正确答案：A。单侧性皮肤黏膜疱疹，沿神经支分布及剧烈的疼痛

解析：带状疱疹常伴有神经痛，但多在皮肤黏膜病损完全消退后1个月内消失，少数患者可持续1个月以上，称为带状疱疹后遗神经痛，常见于老年患者，可能存在半年甚至更长。疱疹初起时颜面部皮肤呈不规则或椭圆形红斑，数小时后在红斑上发生水疱，逐渐增多并能合为大疱，严重者可为血疱，有继发感染则为脓疱。数日后，疱浆混浊，逐渐形成结痂，1～2周脱痂，遗留色素沉着，遗留的色素可逐渐消退，一般不留瘢痕，损害不超越中线。老年人的病程常为4～6周，也有超过8周者。掌握“带状疱疹”知识点。